结扎输精管常在
A. 输精管睾丸部
B. 输精管精索部
C. 输精管腹股沟管部
D. 输精管盆部
E. 射精管

正确答案：B。输精管精索部

解析：输精管精索部（B对）位置表浅，易于触及，为结扎输精管的理想部位。